一个国家和地区针对突发环境污染事件的预防、预警、紧急处置和恢复重建所制定的一系列工作计划，应被规范地称之为
A. 应急预案
B. 预警系统
C. 应急响应
D. 应急保障
E. 应急准备

正确答案：E。应急准备

解析：本题考查应急准备。应急准备（E对ABCD错）是指一个国家和地区针对突发性事件的预防、预警、紧急处置所制定的一系列工作计划，主要内容包括建立预案体系、指挥决策体系、风险排查、队伍建设（含专家队伍和处置队伍）、培训演练、物质保障等。